会引起齿龈增生的药物是
A. 苯巴比妥
B. 地西泮
C. 苯妥英钠
D. 阿司匹林
E. 卡比多巴

正确答案：C。苯妥英钠

解析：本题考查苯妥英钠。苯妥英钠（C对）不良反应有行为改变、步态不稳、眼球震颤、共济失调、肌力减弱、齿龈增生等；苯巴比妥（A错）不良反应为出现“宿醉”现象；地西泮（B错）不良反应有嗜睡、精神依赖性、共济失调等；阿司匹林（D错）不良反应为胃肠道反应；卡比多巴（E错）不良反应有恶心、呕吐、体位性低血压等。